心外形的描述哪条不准确
A. 心底大部分由左心房、小部分由右心房构成
B. 心表面近心底处，有一完整环形的冠状沟
C. 左、右心耳为左、右心房前方的突出部
D. 心尖由左心室构成
E. 前后室间沟是左、右室的表面分界

正确答案：B。心表面近心底处，有一完整环形的冠状沟

解析：心底大部分由左心房、小部分由右心房构成（A对）。冠状沟近似环形（B错，为本题正确答案），并非完整环形。心尖由左心室构成（D对）。前后室间沟是左、右室的表面分界（E对）。